胃炎的急诊胃镜检查应在上消化道出血后
A. 1周内进行
B. 5天内进行
C. 4天内进行
D. 3天内进行
E. 1～2天内进行

正确答案：E。1～2天内进行